患者男，76岁，8天来夜间咳嗽，痰多，诊断为急性支气管炎，除抗感染治疗外，在选服右美沙芬时应加用的药品是
A. 洛贝林
B. 安钠咖
C. 氨茶碱
D. 可待因
E. 氨溴索

正确答案：E。氨溴索

解析：本题考查急性支气管炎的临床用药。患者男，76岁，8天来夜间咳嗽，痰多，诊断为急性支气管炎，除抗感染治疗外，在选服右美沙芬时应加用的药品是氨溴索（E对）。患者确诊急性支气管炎，夜间咳嗽、痰多，除抗感染外，还需要镇咳、祛痰。右美沙芬是非依赖性中枢镇咳药，可用于急性支气管炎镇咳；氨溴索是祛痰药物，有祛痰、稀释痰液的效果，两者无相互作用成分，可以合用。